治疗痢疾之湿热痢，应首选
A. 不换金正气散
B. 芍药汤
C. 驻车丸
D. 桃花汤
E. 连理汤

正确答案：B。芍药汤

解析：不换金正气散为痢疾之寒湿痢的选方，功能燥湿运脾（A错）。痢疾之湿热痢为湿热蕴结，熏灼肠道，气血壅滞所致，治宜清肠化滞，调气和血，方选芍药汤（B对）。驻车丸常合黄连阿胶汤治疗痢疾之阴虚痢，功能坚阴养血，清热化湿（C错）。桃花汤常合真人养脏汤治疗痢疾之虚寒痢，功能温中涩肠（D错）。连理汤为痢疾之休息痢的选方，功能温中补脾兼清湿热（E错）。